环烯醚萜类化合物多数以苷的形式存在于植物体中，其原因是
A. 结构中具有半缩醛羟基
B. 结构中具有环状半缩醛羟基
C. 结构中具有缩醛羟基
D. 结构中具有环状缩醛羟基
E. 结构中具有烯醚键羟基

正确答案：A。结构中具有半缩醛羟基

解析：本题考查的是环烯醚萜类的结构。环烯醚萜类化合物多数以苷的形式存在于植物体中，其原因是结构中具有半缩醛羟基（A对）。环烯醚萜类的基本母核为环烯醚萜醇，具有半缩醛及环戊烷环的结构特点，其半缩醛1位羟基性质不稳定，故环烯醚萜类化合物主要以1位羟基与糖成苷的形式存在于植物体内。根据其环戊烷环是否裂环，可将环烯醚萜类化合物分为环烯醚萜苷及裂环环烯醚萜苷两大类。